维生素D缺乏性佝偻病可靠的早期诊断指标是
A. 血钙降低
B. 血磷降低
C. 血镁降低
D. 血1，25-（OH）₂D₃降低
E. 血碱性磷酸酶增高

正确答案：D。血1，25-（OH）₂D₃降低

解析：维生素D缺乏性佝偻病可造成维生素D缺乏，肠道吸收钙、磷减少和低钙血症，但这一变化的发展需要一个过程，维生素D在肝脏羟化成25-（OH）2D3，是维生素D在循环中的主要形式；25-（OH）2D3在肾脏进一步羟化成1，25-（OH）2D3，是维生素D的活化形式。体内维生素D缺乏初期，机体最先出现的变化是各种形式的维生素D浓度降低，由于25-（OH）2D3在循环中含量最高，因此为常用的临床检查指标（1，25-（OH）2D3在体内含量较少，少用作临床诊断佝偻病的指标，但本题只有D最符合题意）（D对）。血钙（A错）、血磷（B错）、血镁（C错）以及血碱性磷酸酶（E错）的变化都是由于维生素D缺乏，机体吸收钙离子不足代偿后的结果。